某患者新诊断为退行性膝关节炎，既往有磺胺过敏史，不宜选用的非甾体抗炎药是
A. 布洛芬
B. 塞来昔布
C. 双氯芬酸
D. 吲哚美辛
E. 美洛昔康

正确答案：B。塞来昔布

解析：本题考查塞来昔布。不宜选用的非甾体抗炎药是塞来昔布（B错，为本题正确答案）。塞来昔布具有类似磺胺结构，会发生类磺胺过敏反应；布洛芬（A对）用于缓解轻至中度疼痛以及普通感冒或流行性感冒引起的发热；双氯芬酸（C对）用于急性关节炎症和痛风发作、慢性关节炎症、类风湿性关节炎、强直性脊柱关节和脊柱的其它炎性风湿性疾病；吲哚美辛（D对）用于各类关节炎、软组织损伤、各种疼痛等；美洛昔康（E对）用于类风湿关节炎的症状治疗、疼痛性骨关节炎（关节病、退行性骨关节病）的症状治疗。